川楝子、槟榔皆具有的功效是
A. 杀虫行气
B. 杀虫利水
C. 行气利水
D. 行气疏肝
E. 行气健脾

正确答案：A。杀虫行气

解析：川楝子的功效是行气止痛，杀虫；槟榔的功效是杀虫消积，行气，利水，截疟川楝子、槟榔皆具有的功效是行气杀虫（A对）。川楝子可用治蛔虫等引起的虫积腹痛与槟榔同用。